男，25岁，1小时前重物砸伤右前臂，诊断为尺桡骨双骨折，手法复位管型石膏固定术后X线复位满意，此后疼痛不能缓解且持续加重，查石膏牢固，右手部皮肤感觉减退，手指主动活动受限，被动牵拉疼痛加重，首先应给予处理措施
A. 应用消肿止痛药
B. 立即松绑石膏观察
C. 抬高患肢促进血液回流
D. 切开减张术
E. 继续观察

正确答案：B。立即松绑石膏观察

解析：该患者男，25岁，诊断为尺桡骨双骨折，行手法复位管型石膏固定术后X线复位满意，但此后疼痛不能缓解且持续加重，查石膏牢固，右手部皮肤感觉减退，手指主动活动受限，被动牵拉疼痛加重，结合患者出现的表现，为防止发生骨筋膜室综合征，应给予立即松绑石膏观察的治疗（B对ACE错）。如果筋膜室压力大于30mmHg,应及时行筋膜室切开减压（D错）术。